年长病人的念珠菌口角炎多与下列哪项有关
A. 年长者易患系统疾病
B. 年长者抵抗力较低
C. 长期服用各种药物尤其是抗生素
D. 咬合垂直距离缩短，唾液易从口角溢出呈长期潮湿状态
E. 以上均不是

正确答案：D。咬合垂直距离缩短，唾液易从口角溢出呈长期潮湿状态

解析：本题考查念珠菌性口角炎。念珠菌口角炎是由念珠菌感染引起的发生在双侧口角区的皮肤和黏膜的皲裂。由于年长者常用牙列缺失，戴有全口义齿。如果全口义齿的垂直距离过低，患者过度闭口，口角区皮肤发生塌陷呈沟槽状，导致唾液由口角溢入沟内，呈潮湿状（D对），有利于念珠菌生长繁殖，从而引起念珠菌口角炎。年长者抵抗力较低（B错）引起年长者易患系统疾病（A错）会引起全身性疾病如糖尿病、高血压等，糖尿病的并发症为牙周炎，患高血压长期服用某些降压药会出现药物性牙龈增生，不会特异性地累及口角区。长期服用各种药物尤其是抗生素（C错）会导致口腔菌群失调，引起急性红斑性念珠菌口炎。